含副交感神经节后纤维的是
A. 白交通支
B. 灰交通支
C. 鼓索
D. 盆内脏神经
E. 睫状短神经

正确答案：E。睫状短神经

解析：周围部的副交感神经节，位于器官的周围或器官的壁内，称器官旁节和器官内节，节内的细胞即为节后神经元，位于颅部的副交感神经节较大，肉眼可见，有睫状神经节（E对）、下颌下神经节、翼腭神经节和耳神经节等。白、灰交通支（AB错）由交感神经节前纤维构成。鼓索（C错）内含节前纤维。节前纤维由脊髓骶部第2-4节段的骶副交感核发出，随骶神经出骶前孔，而后从骶神经分出组成盆内脏神经加入盆丛，随盆丛分支分布到盆腔脏器（D错）。